表示表面活性剂分子中亲水和亲油基团对油或水的综合亲合力
A. F值
B. HLB值
C. Krafft点
D. 昙点
E. F₀值

正确答案：B。HLB值